鉴别肝癌与肝血管瘤最佳的检查方法是
A. 腹部MRI
B. 腹部多普勒超声
C. 放射性核素肝扫描
D. 腹部CT平扫
E. 内镜超声

正确答案：A。腹部MRI

解析：鉴别肝癌与肝血管瘤最佳的检查方法是腹部MRI（A对）。肝海绵状血管瘤MRI信号颇具特征性，肿瘤在T₁WI上表现为均匀低信号，而T₂WI及其脂肪抑制序列上表现为均匀高信号，且随回波时间延长，高信号表现更为显著，呈所谓“灯泡征”。而肝细胞癌在T₂WI上表现为稍高信号，与海绵状血管瘤表现明显不同。（七版医学影像学P183）。肝血管瘤超声表现为均匀高回声肿块，境界清楚；而肝癌超声表现为肝内单发或多发肿块，回声复杂，可表现为不均匀的低、等、高回声或混合回声，二者不易鉴别（B错）。放射性核素肝扫描（C错）可用于探查肿大肝脏有无占位性病变，检查恶性肿瘤有无转移，对比肝癌放化疗前后的疗效等。腹部CT平扫（D错）两者均表现为低密度肿块，在增强扫描时，肝血管瘤表现为“早出晚归”强化特征，而肝细胞癌表现为“快进快出”强化特征，但MRI在诊断良恶性肝内占位病变时，特别与血管瘤的鉴别优于CT（八版外科学P433）。超声内镜（E错）主要用于对消化道管壁粘膜下生长的病变性质进行鉴别诊断，并可对消化道肿瘤进行术前分期，判断其侵袭深度和范围，鉴别溃疡良恶性等。